男，55岁。间断咳嗽咳痰，反复发作30年，近2年来渐觉气短，发现高血压3年，吸烟36年，2包/日。查体：心肺无明显阳性体征，心脏彩超未发现异常，为明确诊断首选的检查是
A. 胸部CT
B. 肺功能
C. 运动心肺功能
D. 冠状动脉造影
E. 核素心肌显影

正确答案：B。肺功能

解析：患者吸烟36年（慢阻肺的重要环境因素），有高血压，咳嗽、咳痰气短，病程较长，无其他阳性体征，可诊断为慢性阻塞性肺疾病（COPD）。COPD是以持续气流受限为特征的疾病，首选肺功能（B对）检查，因为肺功能检查中FEV₁/FVC＜0.70是判断持续气流受限的主要指标。本病心肺无明显阳性体征，故胸部CT（A错）特异性不高，且CT价格昂贵，一般不作为慢阻肺首选检查。运动心肺功能（C错）是指伴有代谢测定（摄氧量、二氧化碳排出量等）的心肺运动试验，是综合心、肺、代谢指标、通气指标及心电图的变化等，强调心肺联合功能测定，本病心肺无明显阳性体征。冠状动脉造影（D错）是诊断冠心病的金标准，不用于诊断慢阻肺。核素心肌显影（E错）反映心肌血流灌注状况，根据不同征象诊断心肌缺血、梗死，不用于诊断呼吸系统疾病。